妊娠期妇女血容量发生变化，容易出现
A. 生理性贫血
B. 缺铁性贫血
C. 巨幼红细胞性贫血
D. 混合型贫血
E. 病理性贫血

正确答案：A。生理性贫血

解析：本题考查妊娠期妇女血容量发生变化，容易出现的贫血类型。妊娠期妇女与非妊娠妇女相比，血浆容积增加约为45%～50%, 红细胞数量增加约为15%～20%，使血液相对稀释，容易导致生理性贫血（A对BCDE错）。